由于氯吡格雷部分经CYP2C19转化为活性代谢物，合用抑制此酶活性的药物会降低氯吡格雷的疗效，故不推荐与氯吡格雷合用的质子泵抑制剂是
A. 兰索拉唑
B. 奥美拉唑
C. 泮托拉唑
D. 雷贝拉唑
E. 右兰索拉唑

正确答案：B。奥美拉唑

解析：本题考查药物相互作用。不推荐氯吡格雷与奥美拉唑（B对）或艾司奥美拉唑联合使用。因奥美拉唑可抑制氯吡格雷活化（CYP2Cl9参与），可能减弱其抗血小板作用而升高血栓形成的风险。